以下哪项不会引起性发育迟缓
A. 下丘脑病变
B. 垂体病变
C. 卵巢发育不良
D. 处女膜病变
E. 甲状腺功能不良

正确答案：D。处女膜病变